时点患病率在理论上是无长度的，但实际上以不超过多长时间为度
A. 1天
B. 1个星期
C. 1个月
D. 6个月
E. 1年

正确答案：C。1个月

解析：本题考查患病率的分类。患病率可按观察时间的不同分为时点患病率和期间患病率。时点患病率的观察时间一般不超过一个月（C对ABDE错），而期间患病率所指的是特定的一段时间，通常为几个月，但调查时间应尽可能短，以免季节温度等影响患病率的因素发生变化。